农场养牛工，男，35岁。冬季某日翻倒未充分晒干而有霉变的干草，夜晚咳嗽、胸闷、气急、四肢酸痛、畏寒而就诊。查体：体温37.2℃，白细胞总数和中性粒细胞百分比增高。听诊闻及两肺少许水泡音。胸部X线片显示两肺点状阴影。本病最可能的诊断是
A. 尘源性支气管炎
B. 职业性超敏反应性肺泡炎
C. 棉尘症
D. 尘肺
E. 职业性哮喘

正确答案：B。职业性超敏反应性肺泡炎